疾病的流行是
A. 罹患率大于10％
B. 发病率以十万分率计算
C. 某病的发病率虽低，但在该地区人群中却长年不断
D. 某病的发病数明显超过往年同期发病数
E. 某病的发病呈季节性升高

正确答案：D。某病的发病数明显超过往年同期发病数